膀胱叙述错误的是
A. 分为膀胱尖、体、底三部分
B. 新生儿膀胱高于成人
C. 收缩时黏膜汇聚成膀胱襞
D. 前方为耻骨联合
E. 膀胱颈较固定

正确答案：A。分为膀胱尖、体、底三部分

解析：膀胱分尖、体、底和颈四部（A错，为本题正确答案），充盈时尖、体、头位置发生改变，膀胱颈的位置较固定（E对），收缩时黏膜聚集成皱襞称膀胱襞（C对）。膀胱前方为耻骨联合（D对），新生儿膀胱的位置高于成年人（B对），尿道内口在耻骨联合上缘水平，成年人膀胱空虚时始终位于耻骨联合上缘之下。